综合描述疾病的“三间分布”，最经典的流行病学方法是
A. 出生队列研究
B. 横断面研究
C. 移民流行病学研究
D. 血清流行病学
E. 遗传流行病学

正确答案：C。移民流行病学研究

解析：本题考查移民流行病学的概念。移民流行病学（C对ABDE错）是进行疾病人群、地区和时间分布综合描述的一个典型，是通过观察疾病在移民、移居地当地居民及原居地人群间的发病率或死亡率的差异，从而探讨疾病的发生与遗传因素或环境因素的关系。